不易引起空洞的肺炎是
A. 肺炎链球菌肺炎
B. 金黄色葡萄球菌肺炎
C. 克雷伯杆菌肺炎
D. 大肠杆菌肺炎
E. 梭形杆菌肺炎

正确答案：A。肺炎链球菌肺炎

解析：肺炎链球菌（A对）不产生毒素，不引起组织坏死或形成空洞，其致病力是高分子多糖体的荚膜对组织的侵袭作用。金黄色葡萄球菌肺炎（P48）（B错）导致肺叶或肺小叶浸润，脓胸，早期形成空洞，可见液气囊腔。克雷伯杆菌肺炎（C错）导致肺叶或肺段实变，蜂窝状脓肿，形成空洞。大肠杆菌肺炎（D错）导致支气管肺炎，脓胸，形成空洞。梭形杆菌肺炎（E错）为厌氧菌导致的肺炎，导致支气管肺炎、脓胸、多发性肺脓肿，形成空洞。